患者男性18岁，右下颌角隆起，右下8未萌出，右下87舌侧膨隆明显肿物，X线显示右下765根尖下方5.0cm×3.0cm圆形低密度影，边界清楚，沿颌骨长轴发展。如穿刺可抽出物质为下列哪种形状可诊断为牙源性角化囊性瘤
A. 淡黄色清亮囊液
B. 黄色油脂样囊液
C. 血性囊液
D. 褐色囊液
E. 翠绿色囊液

正确答案：B。黄色油脂样囊液

解析：本题考查牙源性颌骨囊肿。牙源性角化囊肿囊内为白色或黄色的角化物或油脂样物质（B对）。